某印染厂男工，45岁，工龄约10年。某日下班后突感到头痛、头晕、口唇及指端发绀，送急诊室就诊。该工人接触的生产性毒物进入机体的主要途径是
A. 呼吸道
B. 消化道
C. 皮肤
D. 口腔黏膜
E. 眼结膜

正确答案：C。皮肤

解析：本题考查苯胺进入机体的途径。从事印染行业的工人，处于长期暴露于苯胺的状态。同时长期慢性接触苯胺可出现类神经症，如头晕、头痛等症状，并出现口唇、指端及耳垂等部位的化学性发绀症状，该工人的表现符合苯胺中毒的症状，为苯胺中毒。苯胺进入机体内的方式有多种，苯胺可经呼吸道、皮肤和消化道进入体内。其中，经皮（C对ABDE错）吸收是引起中毒的主要原因。